下列哪个药不会引起药物性牙龈增生
A. 苯妥英钠
B. 维拉帕米
C. 硝苯地平
D. 环孢素
E. 吗啡

正确答案：E。吗啡

解析：本题考查药物性牙龈肥大的病因。吗啡（E错，为本题的正确答案）不会引起药物性牙龈增生。药物性牙龈肥大是指长期服用某些药物而引起牙龈的纤维性增生和体积增大。与药物性龈肥大有关的三类常用药物是：①抗癫痫药物，如苯妥英钠（A对）；②免疫抑制剂，如环孢素（D对）；③钙通道阻滞剂，如硝苯地平（C对）、维拉帕米（B对）等。